五脏分阴阳，肝的阴阳属性是
A. 阴中之阳
B. 阳中之阳
C. 阴中之阴
D. 阳中之阴
E. 阴中之至阴

正确答案：A。阴中之阳

解析：本题考查脏腑的阴阳属性，属于理解记忆内容。心肺居于上属阳，而心属火，主温通，为阳中之阳（B错）；肺属金，主肃降，为阳中之阴（D错）。肝、脾、肾居下属阴，而肝属木，主升发，为阴中之阳（A对）；肾属水，主闭藏，为阴中之阴（C错）；脾属土，居中焦，为阴中之至阴（E错）。